门静脉与腔静脉之间的交通支不包括
A. 前腹壁交通支
B. 直肠上端交通支
C. 腹膜后交通支
D. 直肠下端肛管交通支
E. 胃底食管下端交通支

正确答案：B。直肠上端交通支

解析：门静脉与腔静脉之间的交通支不包括直肠下端肛管交通支。门静脉与腔静脉之间的交通支包括胃底、食管下段交通支（E对）：是门-腔静脉之间的主要交通支。（2）直肠下端肛管交通支（D对）：门静脉血流经过肠系膜下静脉、直肠上静脉，与直肠下静脉和肛管静脉相吻合，流入下腔静脉。（3）前腹壁交通支（A对）：门静脉（左支）血流经脐旁静脉与腹壁上和腹壁下的深静脉相吻合（4）腹膜后交通支（C对）：肠系膜上、下静脉有许多个小分支，在腹腔后与下腔静脉相吻合（B错，为本题正确答案）。